在医德评价中自我评价方式及主观评价力量是指
A. 社会舆论
B. 传统习俗
C. 内心信念
D. 病人评议
E. 院内评价

正确答案：C。内心信念

解析：内心信念是指医学道德信念，即医务人员发自内心的对医学道德义务的真诚信仰和强烈的责任感，是对自己行为进行善恶评价的精神力量。一个人一旦形成了坚定的内心信念，就会在内心信念的支配和驱使下，对自己的道德行为进行自我评价和审判，从而促进人们自觉履行道德义务。掌握“医学道德评价”知识点。